甘油在静脉注射脂肪乳剂中的作用是
A. 油相
B. 乳化剂
C. 等渗调节剂
D. pH调节剂
E. 抑菌剂

正确答案：C。等渗调节剂

解析：本题考查注射剂常用的附加剂。甘油在静脉注射脂肪乳剂中的作用是等渗调节剂（C对）。注射剂中常用的等渗调节剂有氯化钠、葡萄糖、甘油等。静脉注射脂肪乳剂中的油相（A错）是精制豆油。静脉注射脂肪乳剂中的乳化剂（B错）是大豆磷脂。注射剂中常用的抑菌剂（E错）有硫柳汞、三氯叔丁醇、尼泊金类等。